胸痹的病机，总属
A. 气血失和
B. 寒热错杂
C. 气血两虚
D. 本虚标实
E. 上盛下虚

正确答案：D。本虚标实

解析：胸痹病机为本虚标实（D对），虚为气虚、阴伤、阳衰，肺、脾、肝、肾亏虚，心脉失养；实为寒凝、血瘀、气滞、痰浊，痹阻胸阳，阻滞心脉。《金匮要略·胸痹心痛短气病脉证治》将其病因病机归纳为“阳微阴弦”。